与极性大小有关的概念有
A. 偶极矩
B. 比旋光度
C. 介电常数
D. 极化度
E. 折光率

正确答案：A、C、D。偶极矩；介电常数；极化度